UFs项不包括
A. 在人群内部推导到易感亚群或易感个体的不确定性，表示为UFs1
B. 从实验动物资料外推到人的不确定性，表示为UFs2
C. 从亚慢性毒性试验资料推导慢性毒性试验结果的不确定性，表示为UFs3
D. 当用于推导的资料库不完整（如实验物种太少，缺乏生殖毒性资料等）时，表示为UFs5
E. 以上都包括

正确答案：E。以上都包括